患者，女，42岁，因“成骨肉瘤”使用环磷酰胺、甲氨蝶呤联合化疗。用药过程中，患者出现出血性膀胱炎。适宜的处理措施是
A. 停药，给予糖皮质激素
B. 给予糖皮质激素冲击治疗
C. 停药水化，给予美司钠治疗
D. 停药，给予亚叶酸钙治疗
E. 停药，给予洛哌丁胺

正确答案：C。停药水化，给予美司钠治疗

解析：本题考查化疗药物引起的特殊毒副作用及处理。环磷酰胺的主要毒副作用是出血性膀胱炎，处理及预防的措施为停药，充分水化，化疗前、过程中给予美司钠解救（C对）。甲氨蝶呤主要毒副作用为肾毒性、肺纤维化、黏膜损伤，主要处理方式是水化，亚叶酸钙、四氢叶酸钙解救（D错）。紫杉醇的主要毒副作用为过敏反应、心脏传导阻滞、末梢神经炎，处理及预防措施为停药，给予糖皮质激素治疗（AB错）。伊立替康的主要毒副作用为腹泻，处理及预防措施为停药，监测大便情况，服用洛哌丁胺（E错）。